关于医学心理学的实验研究方法，其主要特点是
A. 只在实验室中完成
B. 只以人为被试对象
C. 只记录生物学指标
D. 只在有目的的一定控制条件下进行
E. 只使用各种现代仪器设备

正确答案：D。只在有目的的一定控制条件下进行

解析：实验研究是在控制的条件下观察、测量和记录个体行为的一种研究方法，其主要特点是有目的的在一定控制条件下进行研究（D对）。实验研究法可分为实验室实验法、现场实验法、和临床实验法，不止在实验室中完成（A错）。实验研究以个体行为为研究对象，被试对象不局限为人（B错）。实验过程中可采用观察、交谈、测量和实验等方法，因而不止使用现代仪器设备，记录指标也不止为生物学指标（CE错）。